58岁男性。高血压病史。演讲时突发头痛，呕吐，右侧偏瘫。头CT示左侧基底节区高密度影。最可能的诊断是
A. 脑出血
B. 蛛网膜下腔出血
C. 动脉瘤破裂
D. 短暂性脑缺血发作
E. 脑血栓形成

正确答案：A。脑出血

解析：本例患者老年男性，有高血压病史，演讲时突发头痛，呕吐，右侧偏瘫，头CT示左侧基底节区高密度影，最有可能的诊断是高血压导致的基底节区脑出血（A对）。脑出血是指非外伤性脑实质内出血，好发于基底节区，最常见于高血压合并细小动脉硬化，常在情绪激动等原因导致血压突然升高时发生。典型表现为头痛、呕吐、对侧偏瘫，CT检查可见患侧高密度影。蛛网膜下腔出血（B错）以中青年多见，临床表现还会有典型的脑膜刺激征和眼部症状等，且CT应显示蛛网膜下腔高密度出血影。动脉瘤破裂（C错）是脑出血的原因之一，但该患者是否为动脉瘤破裂还需进一步确诊。短暂性脑缺血发作（D错）CT检查应该正常。脑血栓形成（E错）CT表现无高密度影的出血影像。